关于牙震荡的临床表现的说法，下列错误的是
A. 患牙微酸痛感
B. 患牙可对于冷刺激一过性敏感
C. 牙冠完整，通常不伴有牙体组织的缺损
D. 大幅松动，患牙有移位
E. 叩痛（±）～（＋）

正确答案：D。大幅松动，患牙有移位

解析：牙震荡临床表现有：患牙轻微酸痛感，可有对于冷刺激一过性敏感症状；牙冠完整，通常不伴牙体组织的缺损；轻微松动或不松动，无移位；垂直向或水平向叩痛（±）～（＋）。掌握“牙震荡”知识点。